下列不属于竹叶石膏汤组成的是
A. 竹叶、半夏
B. 麦冬、石膏
C. 人参、粳米
D. 半夏、炙甘草
E. 桂枝、茯苓

正确答案：E。桂枝、茯苓

解析：竹叶石膏汤方中竹叶、石膏清透气分余热，除烦止呕为君药。人参配麦冬，补气养阴生津，为臣药。半夏和胃降逆止呕，为佐药。甘草、粳米和脾养胃，为使药（E错，为本题正确答案）。竹叶石膏汤人参，麦冬半夏甘草临，更加粳米同煎服，暑烦热渴脉虚寻。